具有类似磺胺结构，对磺胺类药物有过敏史的患者需慎用的非甾体药物是
A. 阿司匹林
B. 吲哚美辛
C. 双氯芬酸钠
D. 美托洛尔
E. 塞来昔布

正确答案：E。塞来昔布

解析：本题考查塞来昔布。塞来昔布（E对）为非甾体抗炎药，具有类似磺胺结构，对磺胺类药物有过敏史的患者需慎用。